何首乌具有的功效是
A. 补血，润肺止咳
B. 滋阴，补益心脾
C. 解毒，润肠通便
D. 养血，益胃生津
E. 敛阴，补血益精

正确答案：C。解毒，润肠通便

解析：该题考查何首乌的功效，属记忆内容。何首乌味苦、甘、涩，性微温；入肝、肾经；制用能补益精血，生用能解毒，截疟，润肠通便（C对ABDE错）。